痈的致病菌是
A. 大肠杆菌
B. 拟杆茵
C. 绿脓杆菌
D. β-溶血性链球菌
E. 金黄色葡萄球菌

正确答案：E。金黄色葡萄球菌

解析：疖、痈的感染大多都是由金黄色葡萄球菌感染引起（E对）。大肠杆菌（A错）多为肠源性感染的致病菌。拟杆菌（B错）为机会致病菌，为阑尾炎和败血症的常见菌。绿脓杆菌（C错）为多种化脓性感染的致病菌。β-溶血性链球菌为丹毒（D错）的主要致病菌。